男，70岁，高热，畏寒，剧烈头痛入院，用青霉素无效，发病第5天，除面部外于胸肩等处出现鲜红色斑丘疹，于内衣见有瘙虮，发病10天，外斐试验效价：1：400，诊断为斑疹伤寒宜选用
A. 庆大霉素
B. 磺胺嘧啶
C. 头孢他定
D. 链霉素
E. 多西环素

正确答案：E。多西环素

解析：多西环素为四环素类药物,作为首选药用于立克次氏体感染如斑疹伤寒以及恙虫病、支原体引起的肺炎、布鲁菌病等。掌握“四环素、多西环素及米诺环素”知识点。